下列关于哮喘持续状态的紧急处理哪项是错误的
A. 静脉滴注地塞米松
B. 补充水、电解质
C. 纠正酸中毒
D. 吸氧
E. 口服氨茶碱

正确答案：E。口服氨茶碱

解析：哮喘持续状态的治疗：①吸氧（D对）；②迅速缓解气道痉挛，常用甲泼尼松龙或地塞米松静脉滴注或注射（A对）；③及时进行人工通气；④注意防治并发症：包括预防和控制感染、补充足够液体量以避免痰液黏稠、纠正严重的酸中毒（C对）和调整水、电解质紊乱（B对）。口服氨茶碱（E错，为本题正确答案）为哮喘急性发作的治疗，通过抑制磷酸二酯酶，提高平滑肌细胞内的环腺苷酸浓度，拮抗腺苷受体，增强呼吸肌的力量以及增强气道纤毛清楚功能等，从而起到舒张支气管和气道抗炎作用。